属于非特异性免疫的是
A. 胎盘屏障
B. 胃肠道IgG
C. 脑脊液igM
D. T淋巴细胞
E. 血IgA

正确答案：A。胎盘屏障

解析：胎盘屏障是胎盘绒毛组织与子宫血窦间的屏障，属于非特异性免疫（A对）。胃肠道IgG（B错）、脑脊液IgM（C错）、T淋巴细胞（D错）、血IgA（E错）属于特异性免疫。